不宜生育包括
A. 严重遗传性疾病患者
B. 患者全部或部分丧失自主生活能力
C. 性病患者
D. 子代再发风险高无法进行产前诊断
E. 因之不宜生育医生建议患者采取长效避孕措施，或者施行结扎手术

正确答案：A。严重遗传性疾病患者

解析：本题考查严重遗传性疾病的相关内容。严重遗传性疾病指由于遗传因素先天形成，患者全部或部分丧失自主生活能力和劳动能力的，目前尚无有效治疗方法的，后代再现风险高且无法进行产前诊断的遗传性疾病，属于医学上认为不宜生育的严重遗传性疾病（A对BCDE错）。